人类不易发生维生素E缺乏症的正确的说法有以下几种，但除外
A. 人体对维生素E的利用率太低
B. 维生素E广泛存在于食物中
C. 维生素E贮存于体内多种器官组织中
D. 维生素E可在体内贮留较长时间
E. 维生素E排泄速度较慢

正确答案：A。人体对维生素E的利用率太低